花粉粒类球形，表面有条性状雕纹由两极向四周放射状排列的药材是
A. 洋金花
B. 红花
C. 蒲黄
D. 丁香
E. 金银花

正确答案：A。洋金花

解析：本题考查洋金花的显微鉴别。花粉粒类球形，表面有条性状雕纹由两极向四周放射状排列的药材是洋金花（A对）。洋金花【显微鉴别】粉末：花粉粒类球形或长圆形，直径42～65㎛，表面有条纹状雕纹。花萼、花冠裂片边缘、花丝基部均具非腺毛。花萼、花冠薄壁细胞中有草酸钙砂晶、方晶及簇晶。红花（B错）【显微鉴别】粉末花粉粒类圆球形或椭圆形，直径约至60㎛，外壁有刺或具齿状突起，具3个萌发孔。花冠、花丝、柱头碎片多见，有长管状分泌细胞，常位于导管旁，直径约66㎛，含黄棕色至红棕色分泌物。蒲黄（C错）【性状鉴别】为鲜黄色粉末，体轻，手捻有滑腻感，易附于手指上，放水中则飘浮水面。气微，味淡。以粉细、质轻、色鲜黄、滑腻感强者为佳。花粉粒黄色，呈类圆形或椭圆形，直径17～29㎛，表面有似网状雕纹，周边轮廓线光滑，呈凸波状或齿轮状，单萌发孔不甚明显。丁香（D错）【显微鉴别】粉末花粉粒众多，极面观三角形，赤道面观双凸镜形，具3副合沟。纤维梭形，顶端钝圆，壁较厚。草酸钙簇晶众多，直径4～26㎛，存在于较小的薄壁细胞中，常数个排列成行。油室多破碎，含油状物。金银花（E错）【显微鉴别】粉末花粉粒类球形，表面具细密短刺及细颗粒状雕纹，具3个萌发孔。腺毛较多，头部倒圆锥形、类圆形或略扁圆形，多细胞，柄部亦为多细胞。非腺毛为单细胞，有一种甚长而稍弯曲，壁薄，有微细疣状突起；一种较短，壁厚，具壁疣，有的可见螺纹。